氯丙嗪具有较强的镇吐作用，小剂量时镇吐作用机制是
A. 阻断呕吐中枢
B. 阻断结节－漏斗通路
C. 阻断胃黏膜传入纤维
D. 阻断黑质－纹状体通路
E. 阻断延脑催吐化学感受区的D2受体

正确答案：E。阻断延脑催吐化学感受区的D2受体

解析：氯丙嗪具有较强的镇吐作用。小剂量时可阻断延脑第四脑室底部的催吐化学感受区的D2受体。大剂量的氯丙嗪直接抑制呕吐中枢。掌握“氯丙嗪”知识点。